马鹿茸侧枝一个者习称
A. 莲花
B. 二杠
C. 门庄
D. 单门
E. 三岔

正确答案：D。单门

解析：本题考查的是鹿茸药材的性状鉴别。马鹿茸侧枝一个者习称单门（D对）。马鹿茸：：【性状鉴别】较花鹿茸粗大，分枝较多，侧枝1个者习称“单门”，2个者习称“莲花（A错）”，3个者习称“三岔（E错）”，4个者习称“四岔”或更多。二杠（B错）与门庄（C错）为花鹿茸的鉴别术语。花鹿茸：：【性状鉴别】呈圆柱状分枝，具1个分枝者习称“二杠”，主枝习称“大挺”，离锯口约1cm处分出侧枝，习称“门庄”。具两个分枝者，习称“三岔”。